胸骨左缘第2、3肋间有2～3级柔和的收缩期吹风样杂音
A. 房间隔缺损
B. 室间隔缺损
C. 动脉导管未闭
D. 法洛四联症
E. 复杂性先心病

正确答案：A。房间隔缺损

解析：房间隔缺损时，左房向右房分流，右房血液增加，右室血液也相应增加，肺动脉瓣相对狭窄，出现胸骨左缘2、3肋间有2～3级柔和的收缩期吹风样杂音（A对）。室间隔缺损（B错）典型体征为胸骨左缘3～4肋间有4～5级粗糙收缩期杂音。动脉导管未闭（C错）特征性胸骨左缘第2肋间闻及连续机械性杂音。法洛四联症（D错）胸骨左缘常可闻及收缩期喷射样杂音。复杂先心病（E错）听诊复杂，表现各异，并不特异性表现为为收缩期杂音。